为保障公众的知情权、参与权、表达权和监督权，国家药品监督管理部门开通药品信息查询平台。下列不属于药品信息查询平台公开范围的是
A. 行政审批信息
B. 统计信息
C. 监督抽检信息
D. 立案信息

正确答案：D。立案信息

解析：本题考查上市药品信息公开的范围。公开的范围：（1）各类依法主动公开的信息：包括药品管理的法律法规、各项规章和规范性文件、政策解读、各类公告通告、中药保护品种目录、麻醉药品和精神药品品种目录、国家基本药物目录、非处方药目录等等。（2）行政审批信息（A对）。（3）药品的备案信息（4）药品日常监督检查和飞行检查等监督检查结果信息，通常以公告通告，或监管信息的形式发布。（5）全国药品抽检信息（C对）。（6）药品行政处罚决定的信息。（7）药品监督管理部门责令药品生产经营者召回相关药品的信息。（8）药品监督管理部门的各类统计信息（B对）依据法律法规及时公开，供社会公众查询（D错，为本题正确答案）。